在梦中将对某个对象的情感转移和投向另一个对象的是
A. 象征
B. 移置
C. 凝缩
D. 投射
E. 变形

正确答案：B。移置

解析：移置：指在梦中将对某个对象的情感（爱或恨）转移和投向另一个对象方面去。掌握“心理治疗原则、主要方法及应用”知识点。